下列有关Kennedy第四类的连接体设计说法错误的是
A. 多采用基托将后部人工牙及卡环连接在一起
B. 利用基托与天然牙舌腭侧的制锁作用增强义齿的稳定
C. 利用基托与天然牙舌腭侧的制锁作用增强义齿的固位
D. 基托可覆盖余留前牙的舌隆突以增加牙支持作用
E. 当设计磨牙间接固位体时，可用大基板或前基板后腭杆连接

正确答案：A。多采用基托将后部人工牙及卡环连接在一起

解析：连接体设计：多采用基托将前部人工牙及卡环连接在一起。基托可覆盖余留前牙的舌隆突以增加牙支持作用；也可延伸至第二前磨牙的远中，利用基托与天然牙舌腭侧的制锁作用增强义齿的固位和稳定。当设计磨牙间接固位体时，可用大基板或前基板后腭杆连接。掌握“局部义齿的设计”知识点。